阻断节后迷走神经通路，降低迷走神经兴奋性，产生松弛支气管平滑肌作用，并减少痰液分泌的药物是
A. 异丙托溴铵
B. 氟替卡松
C. 孟鲁司特
D. 沙美特罗
E. 茶碱

正确答案：A。异丙托溴铵

解析：本题考查异丙托溴铵。阻断节后迷走神经通路，降低迷走神经兴奋性，产生松弛支气管平滑肌作用，并减少痰液分泌的药物是异丙托溴铵（A对）。M胆碱受体阻断剂可阻断节后迷走神经通路，降低迷走神经兴奋性，产生松弛支气管平滑肌作用，并减少痰液分泌，目前用作平喘药的有异丙托溴铵和噻托溴铵。氟替卡松（B错）酯化后具有强大的抗炎作用，与人体内的糖皮质激素受体具有高度的亲和力，约为地塞米松的18倍。孟鲁司特（C错）阻断白三烯受体，起效缓慢，作用较弱，仅适用于轻、中度哮喘和哮喘稳定期控制治疗。沙美特罗（D错）适用于哮喘（包括夜间哮喘和运动性哮喘）的长期维持治疗，以及12岁以上儿童伴有可逆性气道阻塞的支气管痉挛的预防治疗。茶碱（E错）不良反应多，治疗窗窄，个体差异大，与很多药物存在不良相互作用，已降为二线用药的平喘药物。